中医学认为妊娠剧吐的主要发病机理是
A. 脾胃虚弱，肝气偏旺
B. 冲气上逆，胃失和降
C. 肝失条达，气机郁滞
D. 痰湿内停，阻郁脾阳
E. 肝气郁结，胃气上逆

正确答案：B。冲气上逆，胃失和降

解析：妊娠剧吐的主要发病机理是冲气上逆，胃失和降。妊娠早期冲脉血气旺盛以养胎，如孕妇冲气夹胃气、肝气或痰湿上逆，可导致胃失和降而反复发生恶心呕吐（B对）。